医学心理学的研究任务包括
A. 患者心理活动的特点以及心理护理的方法的运用
B. 运用心理治疗的方法达到治病、防病与养生保健的目的
C. 心理评估手段在疾病的诊断、治疗、护理与预防中的作用
D. 心理社会因素在疾病的发生、发展和变化过程中的作用规律
E. 以上说法均正确

正确答案：E。以上说法均正确

解析：医学心理学的研究任务：心理社会因素在疾病的发生、发展和变化过程中的作用规律；心理评估手段在疾病的诊断、治疗、护理与预防中的作用；运用心理治疗的方法达到治病、防病与养生保健的目的；患者心理活动的特点以及心理护理的方法的运用。掌握“医学心理学概述、任务与观点”知识点。